有关脾破裂以下哪项是不正确的
A. 行脾切除术
B. 行脾缝合修补术
C. 待失血性休克好转后手术
D. 可收集腹腔内出血行自体输血
E. 白细胞计数升高

正确答案：C。待失血性休克好转后手术

解析：脾脏位于左侧肋弓下，质地较脆，容易遭受外力作用而发生破裂。对于无休克或易纠正的一过性休克、无其他合并伤的患者，可行非手术治疗；有进行性出血或休克表现者，应及时手术治疗（C错，为本题正确答案），以防延误。伤情明确后能保留脾者，可根据伤情，采用生物胶粘合止血、单纯缝合修补（B对）、脾破裂捆扎及部分脾切除等；脾中心部碎裂、脾门撕裂、高龄及多发伤情况严重者需迅速施行全脾切除术（A对）。对于单纯脾破裂、腹腔出血污染较小的患者，可收集腹腔内出血行自体输血（D对），既可节约库存血，又可减少输血反应和疾病传播，且不需检测血型和交叉配合试验。脾破裂时，可引起白细胞和中性粒细胞计数升高（E对），为机体对创伤的一种应激反应。